1996年共发生200例某病病人，在1996年年初已知有800例病人，年内因该病死亡40例，年中人口数1000万，如果该病的发生和因该病死亡的事件均匀分布在全年中，则：1996年期间，该病的死亡率（1/10万）是
A. 0.4
B. 8
C. 10
D. 1.6
E. 2

正确答案：A。0.4

解析：本题考查死亡率的计算。死亡率表示在一定期间内，某人群中总死亡人数在该人群中所占的比例。计算时分子为某人群某年总死亡人数，分母为该人群平均人口数，算得总死亡率为40/1000万＝0.4（A对BCDE错）/10万。